治疗类风湿性关节炎气血亏虚证，应首选
A. 蠲痹汤
B. 三痹汤
C. 独活寄生汤
D. 六味地黄丸
E. 虎潜丸

正确答案：B。三痹汤

解析：三痹汤功用益气活血，补肾散寒，祛风除湿，主治肝肾气血不足，风寒湿痹之虚实夹杂者（B对）。久痹风、寒、湿偏盛不明显者，可选用蠲痹汤作为治疗风寒湿痹基本方剂（A错）。独活寄生汤功用益肝肾，补气血，祛风湿，通经络，适用于治疗类风湿性关节炎肾虚寒凝证（C错）。六味地黄丸功用填精滋阴补肾，主治肾阴精不足证（D错）。虎潜丸功用滋阴降火，强壮筋骨，适用于肝肾不足，阴虚内热之萎证（E错）。